切面黄白色或白色，质脆；气辛香，味辛辣、麻舌的饮片是
A. 赤芍
B. 山豆根
C. 白芷
D. 板蓝根
E. 细辛

正确答案：E。细辛

解析：本题考查的是细辛饮片的性状鉴别。切面黄白色或白色，质脆；气辛香，味辛辣、麻舌的饮片是细辛（E对）。细辛：【性状鉴别】饮片呈不规则的段。根茎呈不规则圆柱形，外表皮灰棕色，有时可见环形的节。根细，外表面灰黄色，平滑或具纵皱纹，可见须根及须根痕。切面黄白色或白色。质脆。气辛香，味辛辣、麻舌。赤芍（A错）：【性状鉴别】饮片为类圆形切片。外表皮棕褐色。切面粉白色或粉红色，皮部窄，木部放射状纹理明显，有的具裂隙。山豆根（B错）：【性状鉴别】饮片呈不规则的类圆形或斜切厚片，外表皮灰棕色至棕褐色，切面皮部浅棕色，木部淡黄色。有豆腥气，味极苦。白芷（C错）：【性状鉴别】饮片为类圆形的厚片。外表皮灰棕色或黄棕色。切面白色或灰白色，显粉性，形成层环棕色，近方形或近圆形，皮部散有多数棕色油点。气芳香，味辛、微苦。板蓝根（D错）：【性状鉴别】饮片呈圆形厚片。外表皮淡灰黄色至淡棕黄色，有纵皱纹。切面皮部黄白色，木部黄色。气微，味微甜后苦涩。